需氯量等于
A. 加氯量＋余氯量
B. 加氯量－余氯量
C. 加氯量×余氯量
D. 加氯量÷余氯
E. 加氯量－需氯量

正确答案：B。加氯量－余氯量

解析：本题考查需氯量。需氯量是指水的加氯消毒处理时用于消灭细菌和氧化水中的有机物所需要的氯量。需氯量＝加氯量－余氯量（B对ACDE错）。